卫生系统有关单位发生高致病性病原微生物（毒）种或者样本被盗、被抢、丢失、泄漏情况的，省级人民政府应当在接到报告后多长时间内向国务院卫生主管部门报告
A. 1小时内
B. 2小时内
C. 立即
D. 3小时内
E. 4小时内

正确答案：A。1小时内